男，27岁，牙龈疼痛，自动出血3天。检查：腐败性口臭，多个牙的牙龈乳头尖端消失变平，下切牙的龈缘虫蚀状坏死，有灰白膜覆盖。该病的最可能诊断是急性坏死性龈炎，如果明确了诊断，并认为治疗中应使用全身药物，最佳药物选择是
A. 青霉素
B. 阿莫西林
C. 消炎
D. 甲硝唑
E. 增效联磺片

正确答案：D。甲硝唑

解析：本题考查急性坏死性溃疡性龈炎全身药物治疗。该患者诊断为急性坏死性龈炎，重症时可口服甲硝唑（D对）或替硝唑等抗厌氧菌药物2～3天，有助于疾病控制。青霉素（A错）和阿莫西林（B错）对梭形杆菌呈不稳定性敏感，且为广谱抗生素，此处应该应用抗厌氧菌药物。消炎（C错）是一种治疗方法而不是药物。增效联磺片（E错）为甲恶唑、磺胺嘧啶和甲氧苄啶的复方制剂，其抗菌谱广，不如甲硝唑有针对性。